表示观察对象活过t个单位时段的概率
A. 死亡概率
B. 生存率
C. 生存概率
D. 生存时间
E. 中位生存时间

正确答案：B。生存率

解析：本题考查生存率的概念。生存率（B对ACDE错）是指观察对象活过t个单位时段的概率，表示观察对象的生存时间T大于时间t的概率。